下颌牙列的纵（牙合）曲线的最低点位于
A. 第二磨牙远颊尖处
B. 第一前磨牙远颊尖处
C. 第一磨牙近颊尖处
D. 第二磨牙近颊尖处
E. 第一磨牙远颊尖处

正确答案：E。第一磨牙远颊尖处

解析：下颌牙列的纵（牙合）曲线：又名Spee曲线。它是连接下颌切牙的切嵴、尖牙的牙尖以及前磨牙、磨牙的颊尖所形成的一条凹向上的曲线。该曲线在切牙段较平，自尖牙起向后则逐渐降低，于第一磨牙远颊尖处为最低点，而后第二、第三磨牙处又逐渐升高。它表明下颌牙弓的（牙合）面不是一个平面，而是一个有规律的凹面；表示在同一下颌牙列中，各牙的上下位置不在一个平面。掌握“牙列”知识点。